女，30岁。继发不孕伴痛经3年。妇科检查：宫颈光滑，子宫后位，正常大小，黏连固定，经阴道后穹隆扪及触痛结节。应诊断为
A. 慢性盆腔炎
B. 子宫内膜异位症
C. 卵巢癌
D. 子宫腺肌病
E. 盆腔瘀血症

正确答案：B。子宫内膜异位症

解析：患者为育龄期妇女，继发不孕伴痛经3年（子宫内膜异位症的典型症状为继发性痛经、进行性加重，其不孕率高达40%），妇科检查：宫颈光滑，子宫后位，正常大小，黏连固定，经阴道后穹隆扪及触痛结节（双合诊检查时，可发现子宫后倾固定，直肠子宫陷凹、宫底韧带或子宫后壁下方可扪及触痛性结节），凡育龄妇女有继发性痛经进行性加重和不孕病史，妇科检查扪及盆腔触痛性结节或子宫旁不活动的囊性包块，即可诊断为子宫内膜异位症（B对）。慢性盆腔炎（P264）（A错）多有急性盆腔炎病史，可有不同程度的下腹坠痛，经期加重。卵巢癌（P323）（C错）常表现为腹胀、腹部包块及腹腔积液等。子宫腺肌病（P275）（D错）主要症状是经量增多、经期延长和逐渐加重的进行性痛经，其子宫呈均匀性增大或局限性结节隆起，质硬而有压痛。盆腔淤血症（E错）也称为Taylorqa综合，常表现为下腹部疼痛、低位腰痛、白带增多。